某男，9岁。咽喉疼痛，望诊可见咽部有灰白色假膜，擦之不去，重擦出血，随即复生。病属白喉，其病机是
A. 肺胃积热
B. 肺火炽盛
C. 肺热阴伤
D. 虚火上浮
E. 热毒壅盛

正确答案：C。肺热阴伤

解析：本题考查的是望咽喉的临床意义。咽喉疼痛，望诊可见咽部有灰白色假膜，擦之不去，重擦出血，随即复生。病属白喉，其病机是肺热阴伤（C对）。望咽喉：以观察咽喉部的色泽、形态的变化为主。咽喉为肺胃的通路，心、肾、肝、脾、胃等诸经均络于咽喉，所以许多脏腑病变可从咽喉的变化中反映出来。咽喉红肿而痛，多属肺胃积热（A错）；红肿溃烂，有黄白腐点，为肺胃热毒壅盛（E错）；若色鲜红娇嫩，疼痛不甚，多为阴虚火旺；色淡红不肿，久久不愈，是为虚火上浮（D错）；如有灰白色假膜，擦之不去，重擦出血，且随即复生者，是为白喉，属肺热阴伤之证。肺火炽盛（B错）的临床表现，2022年考试指南未明确说明。